刘寄奴的功效是
A. 破血逐瘀，续筋接骨
B. 破血通经，消食化积
C. 活血定痛，敛疮生肌
D. 活血祛瘀，解郁安神
E. 活血通经，清热利湿

正确答案：B。破血通经，消食化积

解析：本题考查的是刘寄奴的功效。刘寄奴的功效是破血通经，消食化积（B对）。刘寄奴：【功效】破血通经，散寒止痛，消食化积。土鳖虫：【功效】破血逐瘀，续筋接骨（A错）。血竭：【功效】活血定痛，化瘀止血，生肌敛疮（C错）。西红花：【功效】活血祛瘀，凉血解毒，解郁安神（D错）。北刘寄奴：【功效】活血祛瘀，通经止痛，凉血止血，清热利湿（E错）。